女，23岁。其末次月经为2000年5月17日，则其预产期为
A. 2月26日
B. 2月27日
C. 2月28日
D. 2月23日
E. 2月24日

正确答案：E。2月24日

解析：整个预产周期约为40周（280天），预产期的计算方法是按末次月经第1日算起，月份减3或加9，日数加7。如果末次月经是2000年5月17日，预产期应是2001年2月24日（E对）。